发生于面部鼻梁两侧的皮肤的鲜红色蝴蝶斑，为哪种疾病的特征
A. 慢性盘状红斑狼疮
B. 带状疱疹
C. 麻疹
D. 风疹
E. 白塞综合征

正确答案：A。慢性盘状红斑狼疮

解析：慢性盘状红斑狼疮发生于面部的鼻梁两侧皮肤呈鲜红色斑，其上覆盖白色鳞屑，称之为蝴蝶斑。掌握“口腔扁平苔藓与慢性盘状红斑狼疮”知识点。